关于损害作用阈值的说法错误的是
A. 阈值量可在实验中确定
B. 损害作用阈剂量应该在实验确定的NOAEL和LOAEL之间
C. 系统毒物和致畸物具有阈值
D. 遗传毒性致癌物无可检测的阈值
E. 性细胞致突变物无可检测的阈值

正确答案：A。阈值量可在实验中确定